患者患乙肝病史10年，肝功能长期异常。近期乏力明显，腹胀，今突然大量呕血。查体：有肝掌、蜘蛛痣，腹壁静脉曲张，肝脾肿大，移动性浊音阳性。应首先考虑的是
A. 消化道溃疡出血
B. 糜烂性胃炎出血
C. 急性白血病出血
D. 食管-胃底静脉曲张破裂出血
E. 肺结核慢性空洞咯血

正确答案：D。食管-胃底静脉曲张破裂出血

解析：患者患乙肝病史10年，肝功能长期异常，查体发现有肝掌、蜘蛛痣，腹壁静脉曲张，肝脾肿大，移动性浊音阳性，故可诊断为肝硬化，近期乏力明显，腹胀，今突然大量呕血，为门静脉高压所致食管-胃底静脉曲张破裂出血（D对）表现。消化道溃疡出血（A错）平时有溃疡的规律性疼痛，呕血黑便。糜烂性胃炎出血（B错）又胃痛，胃胀等上腹部症状。急性白血病出血（C错）表现有发热，贫血，出血。肺结核慢性空洞咯血（E错）表现为咳嗽，咳血，低热，消瘦，盗汗。